肝阳上亢所致的中风，所属发病类型是
A. 感邪即发
B. 徐发
C. 伏而后发
D. 继发
E. 复发

正确答案：D。继发

解析：继发首先本身有原发疾病，并且所产生的新的疾病与原发病在病理上有密切联系。而肝阳上亢所致的中风属于在中风之前就有肝阳上亢，后来又继发了中风，肝阳上亢又是中风的病因（D对）。感邪即发又称为卒发、顿发。指感邪后立即发病、发病迅速之意（A错）。徐发，是指感邪后缓慢发病，又称为缓发。徐发多见于内伤邪气致病（B错）。伏而后发，是指感受邪气后，病邪在机体内潜伏一段时间，或在诱因的作用下，过时而发病，这种发病形式多见于外感性疾病和某些外伤（C错）。复发。是指疾病初愈或疾病的缓解阶段，在某些诱因的作用下，引起疾病再度发作或反复发作的一种发病形式（E错）。